按照WHO标准，判断超重的BMI范围为
A. 18.5～24.9
B. 18.5～22.9
C. 18.5～23.9
D. 23.0～24.9
E. 25.0～29.9

正确答案：E。25.0～29.9

解析：本题考查WHO建议的超重的BMI范围。按照WHO标准，判断超重的BMI范围为25～29.9（E对ABCD错）。